贮存中易发生酸败的剂型
A. 蜜丸
B. 合剂
C. 酒剂
D. 水丸
E. 糖浆剂

正确答案：B、C、E。合剂；酒剂；糖浆剂

解析：本题考查的是中成药贮存中常见的质量变异现象。贮存中易发生酸败的剂型合剂（B对）、酒剂（C对）与糖浆剂（E对）。中成药贮存中常见的质量变异现象：养护不当也会发生变质，并往往与剂型有关。最常见的变质现象有虫蛀、霉变、酸败、挥发、沉淀等。1.虫蛀：虫蛀与原料药的性质及在生产、运输、贮存中受到污染等因素有关，一旦遇到适宜的气候环境就会发生。易虫蛀的常见剂型有蜜丸（A错）、水丸（D错）、散剂等。2.霉变：易霉变的常见剂型有蜜丸、膏滋、片剂等。3.酸败：易发生酸败的剂型有合剂、酒剂、煎膏剂、糖浆剂、软膏剂等。4.挥发：挥发，是指在高温下中成药所含挥发油或乙醇的散失。如芳香水剂、酊剂等。5.沉淀：沉淀，是液体制剂的一种常见变质现象。中成药的液体制剂，在温度和pH值的影响下易发生沉淀，常见的剂型有药酒、口服液、注射液等。